下列各项，适用于真寒假热证的治法是
A. 以热治寒
B. 以热治热
C. 以寒治寒
D. 用寒远寒
E. 通因通用

正确答案：B。以热治热

解析：真寒假热证，寒盛于内是疾病的本质，由于排斥阳气于外，可在原有面色苍白、四肢逆冷、精神萎靡、畏寒峔卧、脉微欲绝等寒盛于内表现的基础上，又出现面红、烦热、口渴、脉大无根等假热之象，此证虽有热象，但寒盛于内为本，仍用性味温热的药物治疗，以热治热（B对）。